分离α-细辛醚和β-细辛醚用
A. AgNO3硅胶柱色谱
B. 60%～65%H3P04
C. 吉拉尔试剂
D. 氧化铝柱色谱
E. 硅胶柱色谱

正确答案：A。AgNO3硅胶柱色谱